有关质粒的叙述不正确的是
A. 质粒是双股环状DNA
B. 具有自我复制的能力
C. 质粒是细菌核质以外的遗传物质
D. 质粒是细菌必需结构
E. R质粒含有耐药基因

正确答案：D。质粒是细菌必需结构

解析：质粒是能够自主复制的细菌染色体以外的双股环状DNA，相当于0.5%～10%染色体，仅含几十个～几百个基因。细菌所携带的重要质粒有F质粒、Vi质粒、Col质粒和R质粒等。质粒可控制细菌某些生物学性状，如R质粒含有耐药基因。掌握“细菌遗传变异的物质基础及机制”知识点。